两个变量的变化程度存在相关关系就被认为有
A. 相互排斥
B. 相互联系
C. 联系
D. 统计学显著性差异
E. 与有关结果有联系

正确答案：C。联系

解析：本题考查联系的概念。联系（C对ABDE错）是指两个变量的变化程度存在相关关系。